某男，52岁。平素脾胃虚弱。近3日因目赤肿痛，自行服用黄连上清丸，出现胃脘不适，大便稀溏等。针对该患者体征其适宜的服药时间是
A. 饭后
B. 空腹
C. 饭前
D. 睡前
E. 餐中

正确答案：A。饭后

解析：本题考查的是服药时间。平素脾胃虚弱。近3日因目赤肿痛，自行服用黄连上清丸，出现胃脘不适，大便稀溏等。针对该患者体征其适宜的服药时间是饭后（A对）。服药时间：药性不同、治疗的疾病不同，服药的时间也各不相同。（1）空腹（B错）服：活血化瘀药宜空腹服药，如桃核承气汤。峻下逐水药空腹服可使药力直达病所，如十枣汤方。此外，驱虫药空腹服可使药效更佳；攻积导滞药空腹服可使泻下之力更强。（2）饭前（C错）服：补益药宜饭前服以利于吸收，如六味地黄丸、参芩白术散等；制酸药宜饭前服，以减少胃酸分泌，增强对胃黏膜的保护；病在胸膈以下，如肝、肾等脏器疾病宜饭前服，旨在使药力直达病所，发挥最佳效力。（3）饭后服：对胃肠道有刺激的药物及苦寒伤胃之药宜饭后服；健胃消食药宜饭后服，如保和丸、大山楂丸等；病在胸膈以上，如头痛、眩晕、目疾、咽痛等宜饭后服，使药效停留于上焦，便于发挥药效。（4）清晨服：利水蠲饮祛湿剂可于清晨服，如鸡鸣散。此外涌吐药如常山饮、七宝饮等亦宜清晨服用。（5）清晨至午前服：凡需借助阳气扶正祛邪的方药，均宜清晨至午前服。发汗解表药宜取清晨至午前分温三服，病瘥即止，如桂枝汤、麻黄汤、桂枝加葛根汤、九味羌活汤等即宜午前服。此外凡温补肾阳、温阳健脾等的方药，亦宜清晨至午前服，借助阳气充盛之势增强扶正祛邪之药效，如金匮肾气丸、附子理中丸、右归丸等。（6）午后至夜晚服：具有滋阴潜阳、清热解毒、重镇固摄的中药，应在午后至夜晚服，此时为阳中之阴、阴中之阴，可助药物发挥养阴、清热、摄纳、潜藏的功效。例如寒下之剂宜午后至夜晚分服。（7）睡前（D错）服：安神药宜睡前服，如酸枣仁汤、朱砂安神丸、天王补心丸等；涩精止遗药宜睡前服，以便增强治疗梦遗滑精之效；部分缓泻药宜睡前服，以便翌日清晨排便；治疗夜汗出、夜半腹痛者，均宜睡前服用。（8）疾病发作时服：截症药宜于症疾发作前2～4小时服用；平喘药宜于哮喘发作前两小时服用。（9）其他：急性病应立即服药；慢性病宜定时服药；调经药应于经前或经期服用；呕吐、惊厥、石淋、咽喉病须煎汤代茶饮者，均可不定时服药。宜餐中（E错）服的中药，2022年考试指南未明确说明。